颌骨内最常见的牙源性囊肿是
A. 牙源性角化囊肿
B. 含牙囊肿
C. 萌出囊肿
D. 成人龈囊肿
E. 根尖周囊肿

正确答案：E。根尖周囊肿

解析：本题考查牙源性囊肿。颌骨内最常见的牙源性囊肿是根尖周囊肿（E对）。 根尖周囊肿是颌骨内最常见的牙源性囊肿，属于炎症性囊肿，一般经历牙齿龋坏、牙髓炎症和坏死、根尖周组织的炎症和免疫反应、Malassez上皮剩余增殖以及增殖上皮团块中央液化、囊性变等一系列病理过程，因此根尖周囊肿常发生于死髓牙的根尖部。相关牙拔除后，若其根尖炎症未作适当处理而继发囊肿，则称为残余囊肿。牙源性角化囊肿（A错）、含牙囊肿（B错）、萌出囊肿（C错）、成人龈囊肿（D错）均属于牙源性囊肿，但不是颌骨内最常见的牙源性囊肿。